低张性缺氧引起组织缺氧，动脉血氧分压须低于：
A. 12.0kPa（90mmHg）
B. 10.7kPa（80mmHg）
C. 9.3kPa（70mmHg）
D. 8.0kPa（60mmHg）
E. 6.7kPa（50mmHg）

正确答案：D。8.0kPa（60mmHg）

解析：从氧离曲线上可知，氧分压在60mmHg以上时，氧饱和度的变化幅度较小，当 Pa02降至60mmHg以下时，动脉血氧含量和氧饱和度显著降低，引起组织、细胞缺氧，因此低张性缺氧引起组织缺氧，动脉血氧分压须低于60mmHg（D对）。